患者，男，70岁，高血压病史14年，服用依那普利20mg/日，平时血压控制不佳，今晨大便时突然出现头疼、头晕，随即出现右侧肢体活动不利。血压为190/100mHg，头颅CT检查结果为左侧脑出血，出血量约10ml，拟采用内科治疗，该患者首先应采取的治疗措施是
A. 静脉滴注甘露醇注射液
B. 口服氨氯地平片
C. 静脉滴注硝酸甘油注射液
D. 肌内注射利血平注射液
E. 舌下含服硝苯地平片

正确答案：A。静脉滴注甘露醇注射液

解析：本题考查甘露醇。患者出现题干症状，首先应采取的治疗措施是：静脉滴注甘露醇注射液（A对）。根据题干可知该患者症状为脑出血，应先降颅内压，降低颅内压首先以高渗脱水药为主，如甘露醇或甘油果糖、甘油氯化钠等。氨氯地平（B错）用于原发性高血压和慢性稳定性心绞痛及变异型心绞痛。硝酸甘油（C错）用于冠心病心绞痛的治疗及预防，也可用于降低血压或治疗充血性心力衰竭。利血平（D错）用于高血压（不推荐为一线用药）。硝苯地平（E错）用于心绞痛。